甘补而平，不燥不腻的是
A. 饴糖
B. 党参
C. 黄芪
D. 西洋参
E. 白术

正确答案：B。党参

解析：本题考查的是党参的性能特点。甘补而平，不燥不腻的是党参（B对）。党参：【性能特点】本品甘补而平，不燥不腻，入脾、肺经。补气之力逊于人参，多用于脾肺气虚之轻症。又兼生津、养血，可治津亏、血虚等证。饴糖（A错）：【性能特点】本品温补甘缓，质润不燥，入脾、胃、肺经。善补脾益气、缓急止痛，治脾虚乏力、虚寒腹痛。能润肺燥、止咳嗽，治肺虚咳嗽。黄芪（C错）：【性能特点】本品甘温补升，甘淡渗利；生用微温，蜜炙性温，入脾、肺经，主以扶正气，兼能除水邪。既善补中气、升举清阳，又善补肺气、益卫固表，治脾肺气虚、中气下陷、气不摄血、自汗盗汗等，还能托疮毒、利水消肿，治气血不足之疮痈不溃或久溃不敛，以及气虚水肿、小便不利。此外，通过补气又能生血、摄血、生津、行滞，治血虚萎黄、气不摄血之崩漏便血、气津两伤之消渴、气虚血滞之痹痛麻木和半身不遂等。西洋参（D错）：【性能特点】本品苦凉清泄，微甘能补，入心、肺、肾经，为凉补之品。既善补气养阴，又善清热生津，主治气阴两虚或阴虚津伤诸证，兼热者尤宜。白术（E错）：【性能特点】本品甘补渗利，苦温而燥，入脾、胃经，主以温补扶正，兼能祛除水湿。善补气健脾、燥湿利水、止汗、安胎，治脾胃气虚、脾虚水肿、痰饮、表虚自汗及胎动不安。生用、炒用性能小有差别，炒后补脾力强，生用祛湿力强。补气、固表、利水与黄芪相似，力虽稍缓，但长于燥湿与安胎。